5-氟尿嘧啶对下列哪种肿瘤疗效好
A. 膀胱癌和肺癌
B. 消化道癌
C. 卵巢癌
D. 子宫颈癌
E. 绒毛膜上皮癌

正确答案：B。消化道癌

解析：本题考查5-氟尿嘧啶的适应症。5-氟尿嘧啶对消化道癌疗效好（B对）。5-氟尿嘧啶自1957年应用于临床以来，是最早被公认为治疗结直肠癌有效的药物，5-氟尿嘧啶可用于治疗消化道癌、膀胱癌和肺癌（A错）、卵巢癌（C错）、子宫颈癌（D错）、绒毛膜上皮癌（E错）等，其中对消化道癌疗效好。